引发肉瘿的主要因素是
A. 情志内伤
B. 肝肾不足
C. 脾胃不和
D. 气郁痰凝
E. 心脾两虚

正确答案：D。气郁痰凝

解析：肉瘿 情志抑郁，肝失调达，气滞血瘀；或忧思郁怒，肝旺侮土，脾失运化，痰湿内蕴；气滞、痰浊、淤血随经络而行，留注于结喉，聚而成形，形成肉瘿（D对）。情志内伤是引起肉瘿的一方面因素，不是主要因素（A错）。肝肾不足、脾胃不和和心脾两虚不是引发肉瘿的发病因素（BCE错）。